久病累及脾肾，以致脾肾阳虚，温煦气化失司，可以形成：
A. 风气内动
B. 寒从中生
C. 湿浊内生
D. 津伤化燥
E. 火热内生

正确答案：B。寒从中生

解析：久病累及脾肾，以致脾肾阳虚，温煦气化失司，可以导致阳气虚衰，不能制阴祛寒，阴寒内盛（B对）。风气内动的病机主要是肝阳化风、热极生风、阴虚风动、血虚生风，不是脾肾阳虚引起的（A错）。湿浊内生是由于脾的运化功能和输布津液的功能障碍，从而引起湿浊蓄积停滞的病理状态，不是脾肾阳虚引起的（C错）。津伤化燥是由久病伤阴耗液，或大汗、大吐、大下，或亡血失精导致阴亏津少，以及某些热性病过程中的热盛伤阴耗津等所致，不是脾肾阳虚引起的（D错）。火热内生是由于阳盛有余，或阴虚阳亢，或由于气血郁滞，或由于病邪郁结而产生的火热内扰，机能亢奋的病理状态，不是脾肾阳虚引起的（E错）。